患者，男，72岁，既往有高血压、心绞痛、心力衰竭、房室传导阻滞和胃溃疡病史。一个月前，因出现哮喘症状就诊，医师处方布地奈德气雾剂200㎍bid吸入，沙丁胺醇气雾剂100㎍prn吸入，氨氯地平片5mgqd口服及硝酸甘油片0.5mgprn舌下含服治疗。该患者血压控制不佳，可考虑联合使用的抗高血压药是
A. 缬沙坦
B. 非洛地平
C. 普萘洛尔
D. 维拉帕米
E. 复方利血平

正确答案：A。缬沙坦

解析：本题考查降压药。该患者血压控制不佳，可考虑联合使用的抗高血压药是缬沙坦（A对）。缬沙坦属于ARB类药物，尤其适用于伴左心室肥厚、心力衰竭、糖尿病肾病、冠心病、代谢综合征以及不能耐受ACEI的患者。非洛地平（B错）属于二氢吡啶类药物，心动过速、心力衰竭患者慎用。普萘洛尔（C错）属于β受体阻断剂，禁用于二至三度房室传导阻滞及哮喘患者。维拉帕米（D错）为非二氢吡啶类CCB，二至三度房室传导阻滞、心力衰竭患者禁用。利血平（E错）的主要不良反应有抑郁、心动过缓、消化性溃疡等，该患者患有胃溃疡，不宜服用利血平。